心位于胸腔内与周围器官密切相关，是血液循环的核心器官。关于心壁结构的描述，错误的是
A. 从内向外依次为心内膜、心肌膜和心外膜
B. 心内膜为浆膜，表面光滑，有利于血液流动
C. 心肌分内纵、中环、外斜3层
D. 心室肌层夹有大量平滑肌
E. 心房肌和心室肌之间，有致密结缔组织环绕在房室口和动脉口的周围，构成心骨骼

正确答案：D。心室肌层夹有大量平滑肌

解析：从内向外依次为心内膜、心肌膜和心外膜（A对）。心内膜为浆膜，表面光滑，有利于血液流动（B对）。心肌分内纵、中环、外斜3层（C对）。心室肌层为大量心肌纤维（D错，为本题正确答案），少量心肌间质。心房肌和心室肌之间，有致密结缔组织环绕在房室口和动脉口的周围，构成心骨骼（E对）。